直接参与糖原合成的酸是
A. ADP
B. FAD
C. UTP
D. NADH
E. NADPH

正确答案：C。UTP

解析：糖原合成起始于G-6-P，G-6-P变构生成G-1-P，G-1-P再与UTP反应生成UDPG，继而与糖原引物相连合成糖原，根据图6-11糖原的合成与分解亦可知UTP（C对）参与糖原合成（P129）。糖原合成需要消耗ATP，生成ADP，所以ADP（A错）并不参与糖原合成。FAD（B错）是体内氧化还原酶的辅基，主要起递氢体的作用，参与呼吸链，脂肪酸和氨基酸的氧化以及柠檬酸循环（P98）。NADH（D错）产生于糖酵解和三羧酸循环，在生物氧化中起到递氢和递电子的作用，不直接参与糖原合成。NADPH（E错）是磷酸戊糖途径生成的主要产物之一，是许多合成代谢反应的供氢体、参与羟化反应以及维持谷胱甘肽的还原状态，并不直接参与糖原合成（P128）。